下列哪一项与"功能性分流"不符?
A. 又称静脉血掺杂
B. 是部分肺泡通气明显减少而血流未相应减少所致
C. 正常人肺也有功能性分流
D. 肺不张时引起功能性分流
E. 功能性分流部分的静脉血不能充分动脉化而PaOz下降，PaCO2升高

正确答案：D。肺不张时引起功能性分流

解析：在肺实变和肺不张时，病变肺泡完全失去通气功能，但仍有血流，流经的血液完全未进行气体交换而掺入动脉血，类似解剖分流，而非引起功能性分流（D错，为本题正确答案）。